氯化喹啉的不良反应包括以下，除外
A. 视力损害
B. 血压降低
C. 恶心、呕吐
D. 肝功能损害
E. 白细胞数降低

正确答案：B。血压降低

解析：本题考查氯化喹啉的不良反应。服用氯化喹啉，不会引起血压降低（B错，为本题的正确答案）。氯化喹啉对红细胞内期裂殖体具有强大的杀灭作用，能迅速控制临床症状。可用于扁平苔藓、红斑狼疮等疾病的治疗。口服常有恶心、呕吐（C对）等，偶有头痛、头晕、瘙痒、皮疹、剥脱性皮炎、脱发、耳鸣、烦躁等；大剂量可有肝功能异常（D对）、视力模糊、复视、视野缩小（A对）等；可引起白细胞减少（E对）、心肌损害、窦房结抑制、心律失常等，严重者可引起阿斯综合征，可使心跳停搏。